具有中枢性抗胆碱作用的药物是
A. 山莨菪碱
B. 后马托品
C. 阿托品
D. 东莨菪碱
E. 优卡托品

正确答案：D。东莨菪碱

解析：东莨菪碱还有中枢抗胆碱作用，用于帕金森病，可缓解流涎、震颤和肌肉强直等症状（D对）。